收缩时可使足内翻
A. 小腿三头肌
B. 腓骨长肌
C. 尺侧腕屈肌
D. （足母）长伸肌
E. 胫骨后肌

正确答案：E。胫骨后肌

解析：小腿三头肌（A错）包括腓肠肌和比目鱼肌，屈踝关节和膝关节。腓骨长肌（B错）屈踝关节（跖屈）和使足外翻。尺侧腕屈肌（C错）屈和内收腕，屈肘。（足母）长伸肌（D错）伸踝关节（背屈），伸（足母）趾。胫骨后肌（E对）屈踝关节，使足内翻。